生长和发育的表述不正确是
A. 量和质的发展
B. 它们之间相互联系
C. 组织、器官形态的增长的过程
D. 组织、器官功能的成熟的过程
E. 个体在形态和功能方面已全面达到成人水平

正确答案：E。个体在形态和功能方面已全面达到成人水平

解析：生长发育是小儿机体各组织、器官形态的增长和功能成熟的动态过程，是量和质的发展，两者相互联系。生长和发育是小儿不同于成人的基本特征。掌握“小儿生长发育规律”知识点。